先用大量水洗，继用30%～50%乙醇擦洗，再用饱和硫酸钠液湿敷
A. 硫酸灼伤
B. 氢氧化钠灼伤
C. 氧化钙灼伤
D. 苯酚灼伤
E. 沥青灼伤

正确答案：D。苯酚灼伤